激活蛋白激酶A需
A. cAMP
B. cGMP
C. 磷脂酰丝氨酸
D. IP₃
E. GSH

正确答案：A。cAMP